固定桥黏固后患者感到胀痛不适的原因为
A. 咬合过度
B. 基牙受扭力，接触点过紧
C. 桥体龈端接触点过紧
D. 黏固剂过厚
E. 基牙负担加重

正确答案：B。基牙受扭力，接触点过紧

解析：如果没有共同就位道，强行戴入会使基牙受到扭力导致疼痛,接触点过紧会导致邻牙疼痛。选项AE和题干中的“胀痛，不适”不符。选项C桥体龈端接触点过紧主要直接压迫和刺激牙龈，形成创伤性炎症，导致黏膜的疼痛。选项D在临床上修复体和牙体之间有一定的空隙，多余的黏结剂就会从空隙被挤压出来，所以被排除。掌握“固定桥修复后出现的问题及处理”知识点。